典型心绞痛患者，含服硝酸甘油片后，缓解的时间一般是
A. 1分钟之内
B. 1～3分钟
C. 5～10分钟
D. 11～20分钟
E. 21～30分钟

正确答案：B。1～3分钟

解析：典型的心绞痛发作是突然发生的位于胸骨体上段或中段之后的压榨性或窒息性疼痛，亦可能波及大部分心前区，可放射至左肩及左上肢前内侧，舌下含服硝酸甘油片如有效，心绞痛症状应于1～3分钟内缓解（B对）。